下列有关三羧酸循环的说法中正确的是
A. 1摩尔乙酰CoA经三羧酸循环彻底氧化可生成1摩尔ATP
B. 1摩尔乙酰CoA经三羧酸循环彻底氧化可生成5摩尔ATP
C. 1摩尔乙酰CoA经三羧酸循环彻底氧化可生成10摩尔ATP
D. 1摩尔乙酰CoA经三羧酸循环彻底氧化可生成15摩尔ATP
E. 1摩尔乙酰CoA经三羧酸循环彻底氧化可生成20摩尔ATP

正确答案：C。1摩尔乙酰CoA经三羧酸循环彻底氧化可生成10摩尔ATP

解析：1摩尔乙酰CoA经三羧酸循环彻底氧化可生成10摩尔ATP，1摩尔葡萄糖在体内经有氧氧化彻底分解可净生成30或32摩尔ATP。掌握“糖分解”知识点。